在哪一届世界卫生大会上，世界卫生组织各成员国发表了题为“21世纪人人享有卫生保健”的宣言
A. 第48届
B. 第49届
C. 第50届
D. 第51届
E. 以上都不是

正确答案：D。第51届

解析：本题考查世界卫生组织各成员国发表题为“21世纪人人享有卫生保健”宣言的时间。在1998年召开的第51届（D对ABCE错）世界卫生大会上，WHO各成员国发表了题为21世纪人人享有卫生保健的宣言。